下列哪项不符合脑缺血的表现
A. 多发生在60岁以上
B. 多静态起病
C. 多动态起病
D. 意识障碍轻或无
E. 脑脊液无色透明

正确答案：C。多动态起病

解析：脑缺血即脑的短暂性供血不足并出现相应症状，也叫短暂性脑缺血发作（TIA），是由于局部脑或视网膜缺血引起的短暂性神经功能缺损，好发于60岁以上（A对）老年人，多静态起病（B对）（C错，为本题正确答案），发病突然，无前驱症状，意识障碍轻或无（D对），临床症状一般不超过1小时，最长不超过24小时，脑脊液无色透明（E对）、无异常。